幼儿急疹的病原体是
A. 腺病毒7型
B. 人类疱疹病毒6型
C. 呼吸道合胞病毒
D. 副流感病毒
E. 柯萨奇病毒

正确答案：B。人类疱疹病毒6型